半数有效量（ED₅₀）是指
A. 药物产生最大效应时所需剂量的一半
B. 引起50%阳性反应（质反应）或50%最大效应（量反应）的浓度或剂量
C. 一半动物产生毒性反应的剂量
D. 产生等效反应所需剂量的一半
E. 常用治疗量的一半

正确答案：B。引起50%阳性反应（质反应）或50%最大效应（量反应）的浓度或剂量